男性，40岁。乙肝炎病史10年，近2个月右上腹胀痛加重。检查：面部有蜘蛛痣，右上腹压痛，肝肋缘下3cm，质硬，ALT40U/L，HBsAg（+），AFP500μg/L。应首先考虑的是
A. 慢性乙肝活动期
B. 乙肝合并肝硬化
C. 乙肝合并胆囊炎
D. 原发性肝癌
E. 继发性肝癌

正确答案：D。原发性肝癌

解析：患者中年男性，长期乙型肝炎病史（原发性肝癌的常见病因），近两月右上腹胀痛加重（癌肿牵拉肝包膜所致），查体有压痛，肝脏肿大（正常肝脏肋下不能触及），质硬，面部有蜘蛛痣（肝硬化体征），ALT（丙氨酸氨基转移酶）40U/L（正常5～40U/L），HBsAg（乙肝表面抗原）（+）（提示有慢性乙型肝炎或肝硬化），AFP（甲胎蛋白）500μg/L（正常＜25μg/L，原发性肝癌患者的阳性率为70%），综合该患者的病史、体查、实验室检查，该患者诊断考虑为原发性肝癌（D对）。慢性乙肝活动期（P432）（A错）AFP往往呈短期低浓度升高，AFP曲线和ALT动态曲线平行或同步增高，或ALT持续增高至正常的数倍。乙肝合并肝硬化（八版诊断学P418）（B错）时AFP有不同程度增高，但通常小于300μg/L。乙肝合并胆囊炎（八版外科学P460）（C错）ALT常升高，但AFP正常。继发性肝癌（P432）（E错）血清AFP检测一般为阴性。